口服补盐液（ORS）使用范围是
A. 轻中度脱水
B. 中重度脱水
C. 重度脱水
D. 低渗性脱水
E. 髙渗性脱水

正确答案：A。轻中度脱水

解析：ORS（九版儿科学P51）是世界卫生组织推荐用以治疗急性腹泻合并脱水的一种溶液，一般适用于轻度或中度脱水无严重呕吐者（A对）。重度脱水（BC错）（九版儿科学P45）是指由10%的体重减少或相当于100～120ml/kg的体重丢失，体液丢失过多有发生低血压性休克的危险，应采取静脉补液而非口服。低渗性脱水（D错）静脉常输注含盐溶液或高渗盐水，以纠正细胞外液的低渗状态和补充血容量。高渗性脱水（E错）常用5％葡萄糖溶液或低渗的0.45％氯化钠溶液。